工人到医院就诊被诊断为职业病，医院开职业病证明书，在职业病证明书上签字的是
A. 医务科科长
B. 该医院医务部负责人
C. 科主任
D. 该病人诊断医生且具有职业病诊断资格的人
E. 该病人诊断医生及病人

正确答案：D。该病人诊断医生且具有职业病诊断资格的人

解析：职业病诊断证明书应当由参与诊断的取得职业病诊断资格的执业医师签署（D对），并经承担职业病诊的医疗卫生机构审核盖章。职业病诊断证明书应当包括内容：①劳动者、用人单位基本信息；②诊断结论：确诊为职业病的，应当载明职业病的名称、程度（期 ）、处理意见；③诊断时间。